内脏神经叙述错误的是
A. 分布于内脏、心血管和腺体
B. 中枢部位于脑和脊髓
C. 含有感觉和运动两种纤维成分
D. 感觉神经元胞体位于脑和脊神经节内
E. 分为交感神经和副交感神经

正确答案：E。分为交感神经和副交感神经

解析：内脏神经分为可分为感觉性和运动性两种（C对），内脏运动神经调节内脏、心血管等器官的运动及腺体的分泌（A对），中枢位于位于脑和脊髓（B对），其初级感觉神经元胞体也位于感觉性脑神经节和脊神经节内（D对），周围突则分布于内脏和心血管等器官的内感受器，把感受到的刺激传递到各级中枢，也可到达大脑皮质。内脏运动神经可分为交感神经和副交感神经两部分（E错，为本题正确选项）。